患者，男，76岁。晚期胃癌5个月，症见：胃脘隐痛，喜温喜按，泛吐清水，形寒肢冷，便溏，舌淡胖苔薄白，脉沉缓。其证型是
A. 肝胃不和
B. 气血亏虚
C. 脾胃虚寒
D. 痰瘀内结
E. 痰食交阻

正确答案：C。脾胃虚寒

解析：患者为老年男性，胃癌晚期5个月，现主症胃脘隐痛，喜温喜按，泛吐清水，形寒肢冷，便溏可判断患者为虚寒象，又结合患者舌苔脉象可知其证型为脾胃虚寒证（C对）。肝胃不和证症状：胃脘痞满，时时作痛，窜及两胁，嗳气频繁，或进食发噎，舌质红，苔薄白或薄黄，脉弦（A错）。痰食交阻症状：胸膈或胃脘满闷作胀或痛，胃纳减退，厌食肉食，或有吞咽梗噎不顺，呕吐痰涎，苔白腻，脉弦滑（E错）。